在一名牙龈白色病变患者的活检标本中，镜下见牙龈上皮中有带突起的细胞，表现为抗原呈递细胞的免疫细胞化学特点。此细胞最可能为
A. 基底细胞
B. 黑色素细胞
C. 朗格汉斯细胞
D. 颗粒细胞
E. 梅克尔细胞

正确答案：C。朗格汉斯细胞

解析：朗格汉斯细胞：也是一种树枝状细胞，它位于口腔黏膜上皮的深部。在透射电镜下观察时显示胞质内有特殊的朗格汉斯颗粒，它们的功能和细胞的表面特征与巨噬细胞很类似，是一种抗原呈递细胞，与黏膜的免疫功能有关。掌握“口腔黏膜基本结构”知识点。